颞下窝肿瘤作活检宜用
A. 切取
B. 钳取
C. 细针吸取细胞学检查
D. 冰冻切片
E. 脱落细胞检查

正确答案：C。细针吸取细胞学检查

解析：本题考查颞下窝肿瘤的检查诊断。颞下窝肿瘤是指发生于颞下窝处的肿瘤，可包括血管瘤、神经鞘瘤、神经纤维瘤、纤维血管瘤、滑膜肉瘤等类型。细针吸取细胞学检查是采用外径为0.6mm的针头，吸取少量组织，涂片做细胞学检查，进行定性诊断的方法，细针吸取细胞学检查（C对）常可结合临床作出明确诊断，从而避免不必要的手术，但位置深在的肿瘤易造成漏诊，如能在B超引导下进行针吸，则可避免误诊。切取（A错）、钳取（B错）、冰冻切片（D错）易造成瘤细胞种植、转移，所以不宜采用这些方法对颞下窝肿瘤进行检查。脱落细胞检查（E错）是采集人体各部位，特别是管腔器官表面的脱落细胞，经染色后用显微镜观察这些细胞的形态，并作出诊断的检查方法，易造成肿瘤转移。